老年人应用普萘洛尔的不良反应是
A. 诱发、加重青光眼
B. 易发生低血糖反应
C. 诱发哮喘、加重心衰
D. 导致出大汗、发生虚脱
E. 导致脱水、低血钾、电解质紊乱

正确答案：C。诱发哮喘、加重心衰